注射用无菌粉末的溶剂是
A. 制药纯水
B. 自来水
C. 灭菌注射用水
D. 注射用水
E. 饮用水

正确答案：C。灭菌注射用水